男孩，3岁，右侧阴囊内肿块，光滑、有波动感，右侧睾丸未触及。卧位时肿块不消失。首先考虑的诊断是
A. 腹股沟疝
B. 精索鞘膜积液
C. 隐睾
D. 睾丸鞘膜积液
E. 交通性鞘膜积液

正确答案：D。睾丸鞘膜积液

解析：男性患儿，右侧阴囊内肿块，光滑、有波动感（提示鞘膜积液），卧位时肿块不消失，右侧睾丸未触及（提示为睾丸鞘膜积液），结合患儿的症状和体查，首先考虑的诊断为右侧睾丸鞘膜积液（D对）。腹股沟疝（A错）的肿大阴囊，卧位时可以消失，体检可触及睾丸。精索鞘膜积液（B错）肿块多位于腹股沟或睾丸上方，体检可扪及正常睾丸。隐睾（P522）（C错）表现为患侧阴囊空虚感，触诊阴囊内无睾丸。交通性鞘膜积液（E错）的临床表现与睾丸鞘膜积液相似，但肿块在立位时增大，卧位时消失。